根据可预防的疾病负担和费用效果分析，下列临床预防服务项目中最优先推荐的措施是
A. 阿司匹林预防心脑血管病
B. 血脂异常的筛检
C. 糖尿病的筛检
D. 骨质疏松的筛检
E. 流感的免疫接种

正确答案：A。阿司匹林预防心脑血管病

解析：根据有效临床预防服务优先次序表格，排在首位的是阿司匹林化学预防，所以最先推荐于临床预防服务项目（A对）（五版预防医学P149）。